老年人各脏器结构和生理功能都有不同程度的退行性改变，因而影响了药物在体内的吸收、分布、代谢和排泄过程。执业药师在药学服务中应更加重视老年人用药的合理性。下列病案中关于老年人合理使用中药的说法，正确的是
A. 某女，70岁。胸痹心痛长期服银杏叶片，因消化道溃疡加服法莫替丁，两药应间隔1小时以上服用
B. 某男，82岁。心气虚寒导致心悸、失眠多年，可长期服用柏子养心丸以补气养血安神
C. 某女，75岁。消渴并发右下肢溃烂、流脓不止，复患风寒表实证，可给予麻黄汤发汗解表
D. 某女，75岁。反复咳喘多年，有肺肾阴虚表现，可给予黄芪、红参等甘温益气之品
E. 某男，90岁。年老体衰，有阴虚表现，可重用阿胶、熟地黄、玄参等滋补之品

正确答案：A。某女，70岁。胸痹心痛长期服银杏叶片，因消化道溃疡加服法莫替丁，两药应间隔1小时以上服用

解析：本题考查老年人合理应用中药的原则。下列病案中关于老年人合理使用中药的说法，正确的是某女，70岁。胸痹心痛，长期服银杏叶片，因消化道溃疡加服法莫替丁，两药应间隔1小时以上服用（A对）。熟悉药品，恰当选择应用：法莫替丁片为抗溃疡抗酸药，与含有多量黄酮类成分的银杏叶制剂同时服用可产生络合效应，形成螯合物，影响疗效。因此，在服用抗酸类西药时应避免与含黄酮类的中成药如复方丹参片、复方丹参滴丸、银杏叶 片等同服，应分时应用，一般来讲，以间隔1小时为宜。合理用药与用药指导：肝肾功能不全者禁用柏子养心丸；因其含有朱砂，不可过量、久服（B错）。柏子养心丸的水蜜丸每次服用6g，小蜜丸每次服用9g，均宜餐后服用。辨证论治，严格掌握适应证：老年人体虚多病，病情往往复杂多变，若药物使用不当可使病情急转直下，甚至无法挽救，故首先应明确是否需要进行药物治疗。对有些病证可以不用药物治疗的就不用，更不要滥用。不辨证就无法选择中药，掌握了辨证之后，还需要知道哪些中药是治疗此证型的。辨证有误则药不对证，会使机体阴阳偏盛或偏衰，以致病情更趋严重。如疮疡日久、大失血患者即使有表证也应慎用解表药（C错），表虚自汗、阴虚盗汗禁用发汗力较强的解表药，实热证、津血亏虚者忌用温里药。再如羚羊解毒片有疏风、清热解毒功效，治疗外感风热效果好，用于外感风寒者则会加重病情；而川贝止咳糖浆治疗风寒感冒咳嗽有效，若用于肺热咳嗽则会加重病情。老年人合理服用滋补药的注意事项：老年人由于生理功能的衰退，常感到体力、精力不如往年，总想用些滋补药来增强体质，延年益寿。但在使用滋补药时，要严格遵照中医的辨证论治，按需行补，不需不补。如果不辨病证，不分气血、阴阳、寒热、温凉，滥用补药，很容易引起病情加重或诱发新的疾病。例如老年慢性支气管炎日久会出现肺阴虚之象，宜用西洋参、沙参等益气养阴清热，若用红参，偏于甘温，反而使余邪复燃，病情加重（D错）。所以老年人选用补药应弄清自己的体质情况，属于哪一种证型，再根据补药的药性，合理选用，达到补而不滞，滋而不腻。老年人使用某些中药要酌情减量。如阿胶、熟地、玄参等质厚滋腻（E错），易滞胃脘；甘草、大枣、炙黄芪甘味过重，使人气壅中满；黄芩、黄连、黄柏苦寒燥湿，易伤脾阳；川芎耗气、红花破血；以上药物用量均不宜过大。